扩张小静脉，降低回心血量的是
A. 硝酸甘油
B. 呋塞米
C. 氨茶碱
D. 酚妥拉明
E. 硫酸镁

正确答案：A。硝酸甘油

解析：硝酸甘油使周围血管舒张，扩张小静脉，外周阻力减小，回心血量减少，心排出量降低，心脏负荷减轻，心肌氧耗量减少（A对）。呋塞米减少静脉回心血量，降低前负荷（B错）。氨茶碱有正性肌力作用及扩张血管、利尿作用（C错）。酚妥拉明可用使血管扩张，体循环和肺循环阻力下降，降低心室后负荷，降低血压（D错）。硫酸镁直接舒张周围血管平滑肌，引起交感神经节冲动传递障碍，从而使血管扩张，血压下降（E错）。